与细菌侵袭力无关的物质是
A. 荚膜
B. M蛋白
C. 芽胞
D. 血浆凝固酶
E. 透明质酸酶

正确答案：C。芽胞

解析：增强抗吞噬作用的菌体表面结构：即荚膜、菌体表面蛋白（M蛋白）及表面抗原（K抗原、Vi抗原）；以及细菌胞外酶，如血浆凝固酶可增强细菌抗吞噬能力，透明质酸酶、链激酶和DNA酶，均增强细菌的扩散能力。掌握“医院感染及细菌的致病性”知识点。